修复体前磨牙和第一磨牙近中接触区多为
A. 邻面中1/3交界处
B. 颊2/3与中2/3交界处
C. 颊2/3与中1/3交界处
D. 颊1/3与中1/3交界处
E. 颊1/3与中2/3交界处

正确答案：D。颊1/3与中1/3交界处

解析：邻接关系：前磨牙和第一磨牙近中接触区多在邻面颊1/3与中1/3交界处；第一、二磨牙间的接触区多在邻面中1/3处。掌握“牙体缺损修复治疗原则”知识点。